根据《药品经营质量管理规范》，下列不符合药品零售企业经营质量管理规定的是
A. 企业应当具有与其经营范围和规模相适应的经营条件
B. 药品零售企业的执业药师应当在岗执业，并挂牌明示
C. 除药品质量原因外，药品一经售出，不得退换
D. 验收人员应当具有药学、医学、微生物学、化学等专业学历

正确答案：D。验收人员应当具有药学、医学、微生物学、化学等专业学历

解析：本题考查的是药品经营质量管理规范的零售主要内容。药品零售企业从事中药饮片验收人员应当具有中药学中专以上学历或者具有中药学专业初级以上专业技术职称（D错，为本题正确答案）。药品零售企业从事中药饮片质量管理、验收、采购人员应当具有中药学中专以上学历或者具有中药学专业初级以上专业技术职称。药品零售企业应当具有与其经营范围和规模相适应的经营条件（A对），包括组织机构、人员、设施设备、质量管理文件，并按照规定设置计算机系统。药品零售企业营业人员应当佩戴有照片、姓名、岗位等内容的工作牌，执业药师和药学技术人员的工作牌还应当标明执业资格或者药学专业技术职称，在岗执业的执业药师应当挂牌明示（B对）。药品零售企业药品退换：除药品质量原因外，药品一经售出，不得退换（C对）。